在二腹肌后腹深面有
A. 副神经
B. 颈内动脉和颈外动脉
C. 颈内静脉
D. 面动脉
E. 以上都正确

正确答案：E。以上都正确

解析：在二腹肌后腹深面至该肌下缘，有一排重要血管、神经行经颈动脉三角，自后向前依次排列为：副神经、颈内静脉、舌下神经、颈内动脉、颈外动脉及面动脉。掌握“气管颈段、颈动脉三角的解剖特点及临床应用”知识点。